以下有关钙通道阻滞药作用的错误叙述是
A. 减少心肌细胞内Ca²⁺
B. 抑制血小板聚集
C. 增加冠状动脉血流量
D. 增强红细胞变形能力
E. 加快房室结传导

正确答案：E。加快房室结传导